男，29岁。间断腹痛腹泻黏液血便1年，加重2周，大便10余次。静点左氧氟沙星及甲硝唑10天后症状无好转，T39℃，Hb75g/L，粪便培养未见致病菌生长。结肠镜示全结肠弥漫性充血水肿，伴糜烂及不规则浅溃疡，病理为重度慢性炎症。隐窝脓肿形成。该患者首选的治疗药物是
A. 泼尼松龙
B. 美沙拉嗪
C. 头孢类抗生素
D. 异烟肼
E. 蒙脱石

正确答案：A。泼尼松龙

解析：该患者有黏液血便，大便10余次/日，T39℃，Hb75g/L（符合重度溃疡性结肠炎：腹泻＞6次/日，有明显黏液脓血便，体温＞37.5℃、脉搏＞90次/分，血红蛋白＜100g/L，血沉＞30mm/h），考虑诊断为重度溃疡性结肠炎，首选糖皮质激素（泼尼松龙）治疗（A对）：糖皮质激素可用于对5-ASA疗效不佳的轻、中度患者，特别适用于重度的患者。美沙拉嗪（5-氨基水杨酸）（B错）是治疗轻、中度或经糖皮质激素治疗已有缓解的重度溃疡性结肠炎的常用药物。头孢类抗生素（C错）用于控制肠道感染，异烟肼（P70）（D错）为抗结核药物，蒙脱石（E错）为止泻药，均不用于治疗溃疡性结肠炎。